酸中毒引起心力衰竭的主要机制是
A. 心肌能量生成障碍
B. 心肌能量利用障碍
C. 心肌能量储存障碍
D. 心肌兴奋-收缩耦联障碍
E. 心肌收缩蛋白破坏

正确答案：D。心肌兴奋-收缩耦联障碍

解析：酸中毒时，H+主要通过与Ca2+竞争性结合肌钙蛋白，使Ca2+无法充分地与肌钙蛋白结合，导致心肌兴奋-收缩耦联障碍（D对）。